体位试验阳性的肿瘤是
A. 海绵状血管瘤
B. 牙龈瘤
C. 角化囊肿
D. 成釉细胞瘤
E. 神经鞘瘤

正确答案：A。海绵状血管瘤

解析：本题考查体位试验阳性的肿瘤。海绵状血管瘤（A对）体位移动试验阳性。牙龈瘤（B错）是来源于牙周膜及颌骨牙槽突结缔组织的炎性增生物或类肿瘤性病变，不属于真性肿瘤。角化囊肿（C错）多发生于青壮年，好发于下颌第三磨牙区及下颌支部，发展较大时，扪诊时可有乒乓球样的感觉，并发出羊皮纸样脆裂声。成釉细胞瘤（D错）多发于青壮年，以下颌体及下颌角部常见，局部浸润，生长缓慢。神经鞘瘤（E错）来源于神经鞘膜，生长缓慢，包膜完整，可沿神经轴侧向两侧移动，但不易沿神经长轴活动，穿刺可见不凝结褐色血样液体。